属于桡骨下端的结构是
A. 桡神经沟
B. 桡切迹
C. 尺切迹
D. 尺神经沟
E. 桡骨头

正确答案：C。尺切迹

解析：肱骨下端有尺神经沟（D错）。桡神经沟位于肱骨体（A错）。桡切迹位于尺骨上端（B错）。桡骨头位于桡骨上端（E错）。尺切迹属于桡骨下端的结构（C对）。